下列关于循证医疗卫生决策与循证医学的叙述，错误的是
A. 循证医学是最佳的证据、临床经验和病人价值的有机结合
B. 循证医学把最好的证据只用于病人个体
C. 循证医疗卫生决策把最好的证据只用于病人个体
D. 循证医疗卫生决策把最好的证据用于病人群体和人群
E. 循证医疗卫生决策主要包括循证政策、循证采购、循证管理、循证护理

正确答案：C。循证医疗卫生决策把最好的证据只用于病人个体